男婴，6个月。平时多汗，有夜惊，枕秃明显，易激惹，烦躁，睡眠不安。早期诊断最可靠的指标是
A. 血25-（OH）-D₃下降
B. 血25-（OH）-D₃升髙
C. 维生素
D. 血清钙，磷
E. 骨密度

正确答案：A。血25-（OH）-D₃下降

解析：6个月婴儿，易激惹，烦躁，夜惊，枕秃明显，应考虑诊断为维生素D缺乏性佝偻病早期，早期诊断最可靠的指标是血清25-（0H）-D3下降（A对B错）。长期维生素D缺乏会造成肠道吸收钙、磷减少和低钙血症，以致甲状旁腺功能代偿性亢进，PTH分泌增加以动员骨钙释放以维持血钙相对平衡，抑制肾小管重吸收磷造成低血磷结果。但维生素D（C错）、血清钙、磷（D错）都不是早期可靠的诊断指标。骨密度降低为本病的晚期表现（E错）。